以下相对数指标中，属于频率指标的是
A. 死亡率
B. 人口年龄性别构成
C. 门诊病历中内科病例的百分比
D. 抚养比
E. 性别比

正确答案：A。死亡率

解析：常用的相对数指标有率、构成比和相对比。率表示在一定空间或时间范围内某现象的发生数与可能发生的总数之比，说明某现象出现的强度或频率，通常以百分率（％）、千分率（‰）、万分率（1/万）或十万分率（1/10万）等表示，死亡率（A对）表示某年某地每千人口中的死亡人数，反映当地居民总的死亡水平。构成比表示某事物内部各组成部分在整体中所占的比重，常以百分数表示，人口年龄性别构成（B错）和门诊病历中内科病例的百分比（C错）均属于构成比。相对比是A和B两个有关联指标值之比，用以描述两者的对比水平，说明A是B的若干倍，通常用倍数表示，抚养比（D错）和性别比（E错）均属于相对比。